根据全国人民代表大会常务委员会关于授权国务院，在部分地方开展药品上市许可持有人制度试点和有关问题的决定，在试点地区的下列人员，可以申请成为药品上市许可持有人的是
A. 上海市，三甲综合性医院内科的主任医师
B. 广东省某药品连锁企业的总经理
C. 河北省某药物研究所的研究员
D. 四川省某药品批发企业的董事长

正确答案：C。河北省某药物研究所的研究员

解析：本题考查药品上市许可持有人制度。根据全国人民代表大会常务委员会关于授权国务院，在部分地方开展药品上市许可持有人制度试点和有关问题的决定，在试点地区的下列人员，可以申请成为药品上市许可持有人的是河北省某药物研究所的研究员（C对）。《国务院关于改革药品医疗器械审评审批制度的意见》的主要任务包括开展药品上市许可持有人制度试点。允许药品研发机构和科研人员申请注册新药，在转让给企业生产时，只进行生产企业现场工艺核查和产品检验，不再重复进行药品技术审评。